脊髓内体感觉传导的一级纤维是
A. 楔束
B. 内侧丘系
C. 内侧纵束
D. 红核脊髓束
E. 脊髓丘脑侧束

正确答案：A。楔束

解析：薄束和楔束（A对）主要传导本体感觉和精细触觉，为脊髓内体感觉传导的一级纤维。内侧丘系（B错）是由薄束核和楔束核发出的纤维形成的。红核脊髓束（D错）主要兴奋屈肌运动神经元，同时抑制伸肌运动神经元。脊髓丘脑侧束（E错）主要传递痛、温觉信息。